女，35岁。G₂P₁，停经70天，下腹隐痛，阴道不规则流血6天，子宫达脐水平，尿hCG（+）。随访中无需常规检查进行
A. hCG定量测定
B. 月经规律
C. 胸片
D. 定期B超检查
E. 定期性激素水平测定

正确答案：E。定期性激素水平测定

解析：育龄期女性，G2P1（孕2产1），停经70天（10周），下腹隐痛，阴道不规则流血6天（停经8～12周左右开始不规则阴道流血，为葡萄胎的最常见症状），子宫达脐水平，尿HCG（+）。正常妊娠20周末子宫底高度位于脐下1横指，妊娠24周末子宫底高度位于脐上1横指，而该患者停经10周子宫达脐水平，提示子宫异常增大。约半数以上葡萄胎患者的子宫大于停经月份，并伴HCG水平异常升高。综合以上因素，应考虑诊断为葡萄胎。葡萄胎诊断一经成立，应及时清宫，清宫后必须定期随访，以便尽早发现继发性滋养细胞肿瘤并及时处理。随访应包括以下内容：①定期HCG定量测定（A对）。②询问病史，包括月经规律（B对），阴道流血，咳嗽咯血等症状。③妇科检查，必要时可选择B超检查（D对）、X线胸片（C对）或CT检查等。定期性激素水平测定（E错，为本题正确答案）对发现滋养细胞肿瘤没有帮助。